长期使用有中毒风险，不推荐用于慢性肾病所致高磷血症的药物是
A. 人促红素
B. 碳酸镧
C. 非诺贝特
D. 氢氧化铝
E. 骨化三醇

正确答案：D。氢氧化铝

解析：本题考查氢氧化铝。长期使用有中毒风险，不推荐用于慢性肾病高磷血症的药物是氢氧化铝（D对）。重组人促红素（A错）临床上用于肾功能不全所致的肾性贫血、恶性肿瘤化疗所致贫血，外科围手术期的红细胞动员、早产儿贫血。碳酸镧（B错）适用于治疗终末期肾病患者的高磷酸盐血症。非诺贝特（C错）用于治疗成人饮食控制疗法效果不理想的高脂血症，其降甘油三酯及混合型高脂血症作用较胆固醇作用明显。口服骨化三醇（E错）即可恢复肠道对钙的正常吸收，纠正低血钙，缓解肌肉骨骼肌疼痛。